下列关于乳牙与恒牙牙冠的叙述中，不正确的说法是
A. 乳牙体积比同名恒牙要小
B. 乳磨牙体积以第一乳磨牙较小，而第二乳磨牙较大
C. 恒牙牙冠呈乳白色偏黄
D. 乳牙牙冠呈乳白色偏青白
E. 恒牙体积较大，磨牙体积以第二磨牙最大

正确答案：E。恒牙体积较大，磨牙体积以第二磨牙最大

解析：本题考查乳牙与恒牙牙冠的形态特点。恒牙体积较大，磨牙体积以第二磨牙最大（E错，为本题正确答案）不符合乳牙与恒牙牙冠的形态特点。恒牙体积较乳牙大，但第一磨牙体积较第二磨牙大。乳牙呈乳白色（D对），体积较同名恒牙小（A对），牙冠短而宽，乳牙颈部缩窄，颈嵴突出，牙根明显缩小，冠根分明。乳磨牙体积依次递增，第二乳磨牙体积较第一乳磨牙大（B对）。恒牙矿化程度较乳牙高，略偏黄色。（C对）